女婴，10天。拒乳4天。查体，周身皮肤明显黄染，脐部少许脓性分泌物，前囟平软，实验室检查：血WBC25×10⁹/L，中性粒细胞0.80，淋巴细胞0.20，该患儿最重要的诊断是
A. 新生儿脐炎
B. 新生儿肝炎
C. 新生儿化脓性脑膜炎
D. 新生儿败血症
E. 新生儿颅内出血

正确答案：D。新生儿败血症

解析：女婴患者，拒乳4天。查体，周身皮肤明显黄染，脐部少许脓性分泌物，前囟平软，实验室检查：血WBC25×10⁹/L（正常值4～10×10⁹/L），中性粒细胞0.80（正常值0.50～0.70），淋巴细胞0.20（正常值0.20～0.40），综合患者的症状、体征和辅助检查，该患儿最重要的诊断是新生儿败血症（D对）。新生儿脐炎（A错）多无周身皮肤明显黄染的表现。新生儿肝炎（B错）体检有肝脾大，尿色较深。新生儿化脓性脑膜炎（C错）常为败血症的一部分或继发于败血症，脑脊液检查可明确诊断。新生儿颅内出血（E错）有颅内压增高的表现，而无白细胞增高的表现。